烹调蔬菜的合理方法是
A. 先切后洗
B. 长时间浸泡水中，以清除农药
C. 急火快炒
D. 水煮
E. 烧烤

正确答案：C。急火快炒

解析：本题考查烹调蔬菜的合理方法。烹调蔬菜的合理方法是先洗后切（A错），急火快炒（C对BDE错），现做现吃。